社会医学研究工具（问卷或量表）的效度评价不包括
A. 表面效度
B. 质量效度
C. 结构效度
D. 内容效度

正确答案：B。质量效度

解析：本题考查效度评价种类。效度是指测量结果与试图要达到的目标之间的接近程度。效度的评价种类主要从四个方面进行评价：1.表面效度（A对）；2.内容效度（D对）；3.结构效度（C对）；4.准则效度。质量效度（B错，为本题正确答案）不属于效度评价种类。